属于肩周炎诊断依据的是
A. 男性多于女性
B. 右侧多于左侧
C. 肩部疼痛，与动作无关系
D. 肩关节外展、外旋、后伸受限
E. 肩部三角肌无萎缩

正确答案：D。肩关节外展、外旋、后伸受限

解析：肩周炎根据患者病史和临床症状多可诊断。本病是因多种病因致肩盂肱关节囊炎性粘连、僵硬，以肩关节周围疼痛、各方向功能受限为特点，尤其是外展外旋和内旋后伸活动（D对）。本病多为中老年患病，女性多于男性（A错），左侧多于右侧（B错），肩部疼痛与动作及病程相关（C错）。肩周炎后期可出现三角肌、冈上肌等的废用性萎缩（E错）。